患者，男，37岁。有饮酒史。脘腹胀闷作痛，吐血紫黯，夹有食物残渣，口苦口臭，尿黄便秘，舌红苔黄腻，脉滑数。诊为吐血，其证候是
A. 胃热壅盛
B. 肝火犯胃
C. 气虚血溢
D. 络瘀血溢
E. 以上均非

正确答案：A。胃热壅盛

解析：患者长期饮酒，酒为辛热之物，饮酒致胃中积热，热伤胃络，故吐血紫黯；胃中积热，胃失和降，气血不和，故脘腹胀闷作痛；胃为水谷之海，胃主纳谷，胃主降，胃气上逆则见夹有食物残渣；胃热耗津，故大便秘结；舌红苔黄腻，脉滑数为内热之象；故诊为胃热壅盛之吐血（A对）。肝火犯胃证候：吐血色红或紫黯，口苦胁痛，心烦易怒，寐少梦多，舌质红绛，脉弦数（B错）。气虚血溢证候：吐血缠绵不止，时轻时重，血色暗淡，神疲乏力，心悸气短，面色苍白，舌质淡，脉细弱（C错）。络瘀血溢会出现瘀血的症状表现，本题中没有瘀血及舌脉的表现（D错）。以上均非（E错）。